某女，45岁。患有类风湿性关节炎，长期服用解热镇痛药，近期咽喉肿痛，牙痛，邻居介绍服用新癀片。患者购药时像药师咨询，希望了解该药的更多信息。要是询问患者一般情况和用药目的后，结合病人既往治疗情况，阻止了该患者购买新癀片。因为新癀片含有解热镇痛药，为防止重复用药，药师阻止了患者购药，新癀片所含的化学成分是
A. 双氯芬酸
B. 对乙酰氨基酚
C. 布洛芬
D. 吲哚美辛
E. 安乃近

正确答案：D。吲哚美辛

解析：本题考查的是含西药组分的中成药。新癀片所含的化学成分是吲哚美辛（D对）。新癀片：功能清热解毒，活血化瘀，消肿止痛。用于热毒瘀血所致的咽喉肿痛、牙痛、痹痛、胁痛、黄疸、无名肿毒。含西药成分吲哚美辛。对乙酰氨基酚（B错）为感速康胶囊的西药成分。感速康胶囊：功能清热解毒，消炎止痛。用于风热感冒、流行性感冒及上呼吸道感染引起的头痛身痛，鼻塞流涕，咳嗽痰黄，咽喉肿痛，齿龈肿痛等。含西药成分：对乙酰氨基酚、马来酸氯苯那敏、维生素C。安乃近（E错）为小儿解热栓的西药成分。小儿解热栓：功能解热、消炎。用于小儿感冒和上呼吸道感染等小儿发热。含西药成分：安乃近。含双氯芬酸（A错）或布洛芬（C错）的中成药，2022年考试指南未明确说明。